既解表散寒，又宣肺止嗽的中成药是
A. 半夏止咳糖浆
B. 二母宁嗽丸
C. 桂龙咳喘宁胶囊
D. 通宣理肺丸
E. 川贝枇杷露

正确答案：D。通宣理肺丸

解析：本题考查的是通宣理肺丸的功能。既解表散寒，又宣肺止嗽的中成药是通宣理肺丸（D对）。通宣理肺丸：【功能】解表散寒，宣肺止咳。二母宁嗽丸（B错）：【功能】清肺润燥，化痰止咳。桂龙咳喘宁胶囊（C错）：【功能】止咳化痰，降气平喘。川贝枇杷露（E错）即川贝止咳露。川贝止咳露：【功能】止嗽祛痰。半夏止咳糖浆（A错）的功能，2022年考试指南未明确说明。